《中国药典》2010年版一部规定，检查附子中双酯型生物碱限量用
A. 高效液相色谱-质谱法
B. 紫外-可见分光光度法
C. 原子吸收分光光度法
D. 高效液相色谱法
E. 气相色谱法

正确答案：D。高效液相色谱法

解析：本题考查的是中药有毒有害物质的检测方法。《中国药典》2010年版一部规定，检查附子中双酯型生物碱限量用高效液相色谱法（D对）。《中国药典》对毒性成分的测定多采用高效液相色谱法，如制川乌、制草乌、附子中的双酯型生物碱（以含新乌头碱、次乌头碱、乌头碱的总量计）进行限量检查；马钱子中的士的宁，斑蝥中的斑蝥素等。有毒中药药材加工成饮片后，毒性成分减少，如《中国药典》规定乌头碱、次乌头碱和新乌头碱的总量在川乌药材中应为0.050%～0.17%，在制川乌饮片中不得过0.040%；士的宁在马钱子药材中应为1.20%～2.20%，在马钱子粉中应为0.78%～0.82%。使用高效液相色谱-质谱（A错）技术对国产千里光、川楝子、苦楝皮中的毒性成分进行限量检查。紫外-可见分光光度法（B错）的定量方法主要有吸收系数法、标准曲线法和对照品比较法。《中国药典》采用吸收系数法测定紫草中羟基萘醌总色素的含量。《中国药典》中，人工牛黄中胆酸和胆红素、山楂叶、天南星、小儿七星茶口服液中总黄酮、麦冬、心悦胶囊中总皂苷、风湿骨痛胶襄中乌头总生物碱的含量测定采用的是标准曲线法。《中国药典》中，淫羊藿中总黄酮、黄杨宁片中环维黄杨星D、华山参片中生物碱、槲叶干浸膏中多糖的含量测定均采用对照品比较法。原子吸收分光光度法（C错）的测定对象是呈原子状态的金属元素和部分非金属元素，主要用于中药中Ca、Fe、Zn、Mn、Cu、Pb、Se、Cd、As等元素的测定，是中药中有害元素及矿物药测定的常用方法。如《中国药典》中健脾生血颗粒和益气维血颗粒中铁的测定。气相色谱法（E错）的测定对象主要是易于挥发、热稳定性好的样品，如含挥发油或其他挥发性成分的中药。